风湿性二尖瓣狭窄的特有体征是
A. 心尖部第一心音亢进
B. 心尖部舒张期隆隆样杂音
C. 心尖部收缩期吹风样杂音
D. 胸骨左缘第二肋间隙第二心音亢进伴分裂
E. 开瓣音

正确答案：B。心尖部舒张期隆隆样杂音

解析：风湿性二尖瓣狭窄的特征性杂音为心尖区舒张中晚期低调的隆隆样杂音（B对）。二尖瓣狭窄时，可出现心尖部第一心音亢进，但当二尖瓣狭窄且伴有严重的瓣叶病变时，第一心音反而减弱（A错）。心尖部收缩期吹风样杂音（C错）、胸骨左缘第二肋间隙第二心音亢进伴分裂（D错）见于二尖瓣关闭不全。开瓣音见于二尖瓣狭窄而瓣膜尚柔软时，当瓣膜病变严重时，开瓣音消失（E错）。